某男，56岁。咳嗽反复发作，咳声重浊，痰黏色白，胸闷脘痞，食少体倦，大便时溏。诊断为咳嗽，辨析其证候是
A. 痰湿蕴肺
B. 风寒袭肺
C. 风燥伤肺
D. 风热犯肺
E. 痰热郁肺

正确答案：A。痰湿蕴肺

解析：本题考查的是咳嗽的辨证论治。某男，56岁。咳嗽反复发作，咳声重浊，痰黏色白，胸闷脘痞，食少体倦，大便时溏。诊断为咳嗽，辨析其证候是痰湿蕴肺（A对）。咳嗽是指肺失宣降，肺气上逆作声，或伴咳吐痰液，为肺系疾病的主要表现之一。西医学中急慢性支气管炎、部分支气管扩张症、慢性咽炎、咳嗽变异性哮喘等以咳嗽为主要表现时，可参考此内容辨证论治。（一）风寒袭肺证（B错）：【症状】咳嗽声重，气急，咽痒，咳痰稀薄色白，常伴鼻塞，流清涕，头痛，肢体酸楚，或见恶寒、发热、无汗等风寒表证。舌苔薄白，脉浮或浮紧。（二）风热犯肺证（D错）：【症状】咳嗽频剧，气粗，或咳声嗄哑，咳痰不爽，痰黏稠或稠黄，喉燥咽痛，口渴，鼻流黄涕，头痛，肢楚，恶风身热。舌边尖红，苔薄黄，脉浮数。（三）风燥伤肺证（C错）：【症状】干咳，连声作呛，咽痒，咽喉干痛，唇鼻干燥，口干，无痰或痰少而黏，不易咳出，或痰中带血丝，初起或伴鼻塞、头痛、微寒、身热。舌质红而少津，苔薄白或薄黄，脉浮数。（四）痰湿蕴肺证：【症状】咳嗽反复发作，咳声重浊，痰黏腻，或稠厚成块，痰多易咳，早晨或食后咳甚痰多，进甘甜油腻物加重，胸闷脘痞，呕恶，食少，体倦，大便时溏。舌苔白腻，脉滑。（五）痰热郁肺证（E错）：【症状】咳嗽，气息粗促，或喉中有痰声，痰多，质黏稠色黄，或有腥味，难咳，胸胁胀满，或咳时引痛，面赤，或有身热，口干而黏，欲饮水。舌红，苔黄腻，脉滑数。（六）肺阴亏耗证：【症状】咳嗽日久，干咳少痰，或痰中带血，午后咳甚，或伴五心烦热，颧红，耳鸣，消瘦，神疲。舌质红，苔少，脉细数。